病因治疗
A. 阻止毒物继续进入人体内，促使毒物排泄以及拮抗或解除其毒作用
B. 缓解毒物引起的主要症状，以促进入体功能的恢复
C. 提高患者抗病能力，促使早日恢复健康
D. 降低车间空气中毒物浓度
E. 加强个人防护和个人卫生

正确答案：A。阻止毒物继续进入人体内，促使毒物排泄以及拮抗或解除其毒作用